下面关于正确刷牙的方法，错误的描述是
A. 刷上牙内外面时从上往下刷，刷下牙内外面时从下往上刷
B. 刷咬合面时前后拉动着刷
C. 为有效去除牙菌斑，每次刷牙时间不宜少于5分钟
D. 刷牙的最佳时间是进食后3分钟
E. 刷牙后要充分漱口

正确答案：C。为有效去除牙菌斑，每次刷牙时间不宜少于5分钟